一种细胞因子作用于多种靶细胞，产生多种生物学效应为
A. 细胞因子的多效性
B. 细胞因子的重叠性
C. 细胞因子的拮抗性
D. 细胞因子的协同性
E. 细胞因子的特异性

正确答案：A。细胞因子的多效性